在规定的测试条件下，同一个均匀样品经多次取样测定，所得结果之间的接近程度称为
A. 准确度
B. 精密度
C. 专属性
D. 检测限
E. 线性

正确答案：B。精密度